人参皂苷元的主要结构类型是
A. 羊毛甾烷型
B. 呋甾烷型
C. 达玛烷型
D. 异螺旋甾烷型
E. 变形螺旋甾烷型

正确答案：C。达玛烷型

解析：本题考查的是人参皂苷元的结构与类型。人参皂苷元的主要结构类型是达玛烷型（C对）。人参含有皂苷、多糖和挥发油等多种化学成分，人参皂苷为人参的主要有效成分之一。《中国药典》以人参皂苷为指标成分对人参、红参和人参叶进行含量测定。其中，人参和红参的质量控制成分为人参皂苷Rg₁、人参皂苷Re和人参皂苷Rb₁。例如，要求人参中人参皂苷Rg₁和人参皂苷Re的总量不得少于0.30%，人参皂苷Rb₁不得少于0.20%。人参皂苷可以分为三类，分别是人参皂苷二醇型（A型）、人参皂苷三醇型（B型）和齐墩果烷型（C型）。（1）人参皂苷二醇型：人参皂苷二醇型包括人参皂苷Rb₁、人参皂苷Rc和人参皂苷Rd等。（2）人参皂苷三醇型：人参皂苷三醇型包括人参皂苷Re、人参皂苷Rf和人参皂苷Rg₁等。（3）齐墩果烷型：齐墩果烷型包括人参皂苷Ro等。A型、B型的皂苷元属于四环三萜，C型皂苷元则属于五环三萜。A型和B型皂苷元属达玛烷型，为达玛烯二醇的衍生物。三萜：基本骨架由6个异戊二烯单位组成。三萜的种类很多，但以皂苷形式存在的三萜类型并不多，较为常见的有羊毛甾烷型、达玛烷型、齐墩果烷型、乌苏烷型和羽扇豆烷型，其中前两种属于四环三萜，后三种则属于五环三萜。1.四环三萜：结构与甾醇很类似。主要有以下类型。（1）羊毛甾烷型（A错），如猪苓酸A。（2）达玛烷型，如20（S）-原人参二醇。2.五环三萜：主要有以下类型。（1）齐墩果烷型，此类以齐墩果酸最为多见。（2）乌苏烷型，此类大多是乌苏酸的衍生物。（3）羽扇豆烷型，如羽扇豆种子中存在的羽扇豆醇，酸枣仁中分得的白桦醇和白桦酸等。呋甾烷型（B错）、异螺旋甾烷型（D错）与变形螺旋甾烷型（E错）属于甾体皂苷。甾体皂苷与三萜皂苷相似，均由甾体皂苷元与糖组成，这是天然广泛存在的一类化学成分。甾体皂苷分类主要有螺旋甾烷醇类、异螺旋甾烷醇类、呋甾烷醇类和变形螺旋甾烷醇类。1.螺旋甾烷醇和异螺旋甾烷醇类：螺旋甾烷有菝葜皂苷元和剑麻皂苷元等；异螺旋甾烷有薯蓣皂苷元和沿阶草皂苷D苷元等。2.呋甾烷醇类：有原蜘蛛抱蛋皂苷等。3.变形螺旋甾烷醇类：有燕麦皂苷B等。